患者，男性，58岁。因2天前突然严重头痛、恶心、呕吐伴有颈項强直而入院，穿刺检查证明颅内压增高，除一般治疗外，为防治脑血管痉挛，宜选用
A. 硝苯地平
B. 维拉帕米
C. 地尔硫䓬
D. 尼卡地平
E. 氟桂嗪

正确答案：E。氟桂嗪